心肌损伤心电图改变是
A. T波倒置
B. 异常深而宽Q波
C. ST段下移
D. ST段明显上抬，呈弓背向上单向曲线
E. T波高耸

正确答案：D。ST段明显上抬，呈弓背向上单向曲线

解析：心外膜下心肌损伤时（包括透壁性心肌缺血），ST段呈弓背向上抬高（D对）。心肌缺血，面对缺血区的导联出现两肢对称的尖深的倒置T波，一般称为“冠状T波”（A错）。心肌缺血坏死主要表现为面向坏死区的导联出现病理性Q波（时间≥0.03s，振幅≥1/4R），Q波的宽度和深度代表了心肌坏死的范围和深度（B错）。典型心绞痛发作时面对缺血区的导联上出现ST段下移，可呈水平型或下斜型压低≥0.1mV，或在原有的基础上进一步下移达0.1mV以上（C错）。T波高耸常见于高钾血症，心内膜下心肌缺血及急性心肌梗塞超急性期表现（E错）。